茯苓采收加工须
A. 发汗
B. 曝晒
C. 熏硫
D. 晒干或低温干燥
E. 置沸水中略煮或蒸

正确答案：A。发汗